全子宫切除术的无需切断的韧带是
A. 宫骶韧带
B. 子宫主韧带
C. 卵巢固有韧带
D. 子宫圆韧带
E. 骨盆漏斗韧带

正确答案：E。骨盆漏斗韧带

解析：全子宫切除术指切除整个子宫，即子宫体和子宫颈，保留两侧卵巢，切除子宫时，需离断子宫圆韧带（D对）、阔韧带、主韧带（B对）及宫骶韧带（A对）4对固定子宫位置的韧带，卵巢固有韧带（C对）为阔韧带在卵巢内侧与宫角之间增厚形成的，连接子宫与卵巢，需离断后才能使子宫完全游离。骨盆漏斗韧带（E错，为本题正确答案）由阔韧带上缘外1/3包绕卵巢动静脉形成，并将卵巢固定于盆壁，其内包含卵巢动静脉，故全子宫切除时不用离断骨盆漏斗韧带。